鼻唇（鼻牙槽）囊肿常见的症状是
A. 肿胀
B. 溃疡
C. 糜烂
D. 疼痛
E. 瘘管

正确答案：A。肿胀

解析：鼻唇（鼻牙槽）囊肿较为少见，肿胀是常见的症状。掌握“鼻腭管囊肿及鼻唇囊肿”知识点。